糖尿病II型数年双下肢阵发性刺痛，考虑周围神经病变，行什么检查？
A. 心电图
B. 肌电图
C. 下肢血管彩超
D. 腰椎CT
E. 磁共振

正确答案：B。肌电图

解析：糖尿病引起的周围神经病变，肢端感觉异常，可行电生理检查、肌电图检查（B对）。心电图（A错）用于诊断心脏疾病。下肢血管彩超（C错）用于下肢深静脉血栓等。腰椎CT（D错）用于观察有无腰椎损伤。磁共振（E错）用于观察软组织损伤。